关于哺乳期妇女用药安全的说法，正确的是
A. 口服避孕药可分泌至乳汁中，降低乳汁中吡哆醇含量，哺乳期应禁用
B. 依那普利可分泌至乳汁中，因含巯基可引起乳儿骨髓抑制，哺乳期应避免使用
C. 头孢呋辛易分泌至乳汁中，哺乳期不宜使用
D. 阿奇霉素很少分泌至乳汁中，哺乳期可以使用
E. 青霉素G极易分泌至乳汁中，哺乳期不宜使用

正确答案：A。口服避孕药可分泌至乳汁中，降低乳汁中吡哆醇含量，哺乳期应禁用

解析：本题考查哺乳期妇女用药安全。口服避孕药可分泌至乳汁中，降低乳汁中吡哆醇含量，哺乳期应禁用（A对）。口服避孕药因含雌激素和（或）孕激素，可分泌至乳汁中，降低乳汁中吡哆醇含量，使乳儿出现易激惹、尖叫、惊厥等神经精神系统症状；男婴则出现乳房增大。哺乳期妇女避孕应采用宫内安放节育器的方法。卡托普利可分泌至乳汁中，因含巯基，对乳儿骨髓有抑制作用，避免使用；依那普利对乳儿肾脏有影响，避免应用（B错）。头孢菌素类（C错）在乳汁中含量甚微，但第四代头孢菌素类如头孢匹罗、头孢吡肟例外。大环内酯类（D错）100%分泌至乳汁。青霉素类（E错）对乳儿安全。